某女，43岁。患慢性盆腔炎3年，症见带下量多、色黄质稠、臭秽、小腹疼痛、腰骶酸痛、神疲乏力，宜选用的中成药是
A. 妇科千金片
B. 白带丸
C. 花红颗粒
D. 千金止带丸
E. 妇炎平胶囊

正确答案：A。妇科千金片

解析：本题考查的是妇科千金片的主治。患慢性盆腔炎3年，症见带下量多、色黄质稠、臭秽、小腹疼痛、腰骶酸痛、神疲乏力，宜选用的中成药是妇科千金片（A对）。妇科千金片：【主治】湿热瘀阻所致的带下病、腹痛，症见带下量多、色黄质稠、臭秽、小腹疼痛、腰骶酸痛、神疲乏力；慢性盆腔炎、子宫内膜炎、慢性宫颈炎见有上述证候者。白带丸（B错）：【主治】湿热下注所致的带下病，症见带下量多、色黄、有味。花红颗粒（C错）：【主治】湿热瘀滞所致带下病、月经不调，症见带下量多、色黄质稠、小腹隐痛、腰骶酸痛、经行腹痛；慢性盆腔炎、附件炎、子宫内膜炎见有上述证候者。千金止带丸（D错）：【主治】脾肾两虚所致的月经不调、带下病，症见月经先后不定期、量多或淋沥不净、色淡无块，或带下量多、色白清稀、神疲乏力、腰膝酸软。妇炎平胶囊（E错）：【主治】湿热下注所致的带下病、阴痒，症见带下量多、色黄味臭、阴部瘙痒；滴虫、霉菌、细菌引起的阴道炎、外阴炎见上述证候者。